以单纯扩散的方式跨膜转运的物质是
A. Na⁺
B. Ca²⁺
C. O₂和CO₂
D. 葡萄糖
E. 氨基酸

正确答案：C。O₂和CO₂